发热病人较易出现
A. 呼吸性酸中毒
B. 代谢性酸中毒合并呼吸性碱中毒
C. 呼吸性碱中毒
D. 代谢性碱中毒
E. 代谢性酸中毒合并呼吸性酸中毒

正确答案：B。代谢性酸中毒合并呼吸性碱中毒

解析：发热的病人在体温上升期易出现寒战，此时肌肉活动增强，所需的能量大部分依赖于无氧代谢供给，因而产生大量乳酸，机体出现代谢酸中毒；同时发热时，呼吸中枢对CO2的敏感性增强，促使呼吸加快加强，从而出现通气过量，产生呼吸性碱中毒。故发热病人较易出现代谢性酸中毒合并呼吸性碱中毒（B对）。